青年李某，男性，因包茎到某医院做包皮环切术。在局部注射利多卡因后，即刻出现休克反应，经全力抢救无效后死亡。经专家会诊认为其死亡是利多卡因过敏所致，在临床中极为少见。根据《医疗事故处理条例》规定，李某的死亡后果，应当属于
A. 一级医疗事故
B. 二级医疗事故
C. 三级医疗事故
D. 因不可抗力而造成的不良后果
E. 因患者体质特殊而发生的医疗意外

正确答案：E。因患者体质特殊而发生的医疗意外

解析：《医疗事故处理条例》规定了6种情形不属于医疗事故：①在紧急情况下为抢救垂危患者生命而采取紧急医学措施造成不良后果的；②在医疗活动中由于患者病情异常或者患者体质特殊而发生医疗意外；③在现有医学科学技术条件下，发生无法预料或者不能防范的不良后果的；④无过错输血感染造成不良后果的；⑤因患方原因延误诊疗导致不良后果的；⑥因不可抗力造成不良后果的。患者李某注射利多卡因后出现休克，抢救无效死亡，经专家会诊认为其死亡是利多卡因过敏所致，在临床中极为少见，属于因患者体质特殊而发生的医疗意外（E对），不属于医疗事故（ABC错）。不可抗力是指当事人不能预见和人力所不能抗御的强制力量，如台风、洪水、地震或战争等（D错）。